将0.5氨茶碱注射液加到5%葡萄糖注射液250ml中，临床要求给药速度是60mg/h，输注速度是
A. 10ml/h
B. 30ml/h
C. 20ml/h
D. 60ml/h
E. 83.3ml/h

正确答案：B。30ml/h

解析：本题考查输注速度的计算。氨茶碱成人每日静脉滴注或肌注，一次0.25～0.5g。0.5g氨茶碱即500mg氨茶碱，将其加到250ml5%葡萄糖注射液中，即1ml葡萄糖中含有2mg氨茶碱。现要求给药速度为60mg/h，可理解为一小时需要静脉滴注60mg的药物，即输入30ml的葡萄糖，因此输注速度为30ml/h（B对）。